全冠粘固后很快出现过敏性疼痛，导致其发生的原因中最不可能的是
A. 取印模时刺激
B. 粘固剂刺激
C. 患牙为活髓牙
D. 消毒剂刺激
E. 牙体预备时水喷雾不够

正确答案：A。取印模时刺激

解析：修复体粘固后过敏性疼痛原因。①若患牙为活髓牙，在经过牙体切割后，暴露的牙本质遇冷、热刺激会出现牙本质过敏现象。②若牙体预备时损伤大，术后未采取保护措施，牙髓常常充血处于激惹状态。③粘固时，消毒药物刺激、戴冠时的机械刺激、冷刺激加上粘固剂中的游离酸刺激，会引起患牙短时疼痛。待粘固剂充分结固后，疼痛一般可自行消失。由于粘固剂为热、电的不良导体，在口内对患牙起到保护作用，遇冷热不再出现疼痛。④若粘固后牙长时间持续疼痛，说明牙髓受激惹严重，或可发展为牙髓炎。取印模时刺激应出现在取膜时，而不是冠戴入后。掌握“修复体戴入后的问题及处理”知识点。